主要适用于乳牙深龋露髓，部分冠髓牙髓炎，外伤露髓的牙齿的是
A. 间接盖髓术
B. 直接盖髓术
C. 氢氧化钙活髓切断术
D. FC（戊二醛）断髓术
E. 根管治疗术

正确答案：C。氢氧化钙活髓切断术

解析：本题考查牙牙髓病及根尖周病诊断及治疗。主要适用于乳牙深龋露髓，部分冠髓牙髓炎，外伤露髓的牙齿的是氢氧化钙活髓切断术（C对）。乳牙牙髓切断术：在局部麻醉下将冠部牙髓组织切断和去除，保留根部生活牙髓的治疗方法。适用于深龋露髓，部分冠髓牙髓炎，外伤露髓的牙齿。所用药物为甲醛甲酚、戊二醛、氢氧化钙、硫酸铁、MTA等。备洞时的意外穿髓，露髓孔直径小于0.5mm的患牙应采用直接盖髓术（B错）；深龋治疗时为避免露髓，保留洞底近髓部分龋坏牙本质应采用间接盖髓术（A错）；保留牙髓坏死或根尖周感染的乳牙最后的治疗手段的是管治疗术（E错）。近年研究发现FC具有半抗原作用，可能导致根尖周、牙周组织的免疫学反应；由于FC溶液中的甲醛渗透性强，易引起根尖周、牙周组织的刺激；术后发生牙根内吸收或牙根病理性吸收。因此，FC应用引起了争议（D错）。